四环素族药物具有酶的活性，阻止骨吸收的作用，其抑制的酶主要为
A. 胶原酶
B. 蛋白酶
C. 透明质酸酶
D. 水解酶
E. 硫酸软骨素酶

正确答案：A。胶原酶

解析：本题考查牙周病的全身药物治疗-四环素族药物。四环素族药物具有酶的活性，阻止骨吸收的作用，其抑制的酶主要为胶原酶（A对）。近年的研究表明：四环素族药物还能抑制胶原酶及其他基质金属蛋白酶的活性，抑制结缔组织的破坏，阻断骨的吸收促进牙周组织再生。四环素族药物通过与胶原酶活化所必需的金属阳离子Ca²⁺、Zn²⁺螯合，抑制中性粒细胞和细菌所产生的胶原酶；四环素族药物由于其本身为酸性，且具有金属螯合作用，使用这类药物处理根面还能使根面轻度脱矿，牙本质小管开放，使暴露的胶原刺激牙周膜细胞在根面上迁移，直接促进细胞附着与生长。此作用依赖于局部药物浓度和作用持续时间，过高浓度、过长时间的接触反会抑制成纤维细胞的生长。四环素族药物抑制胶原酶的作用不依赖于其抗菌性能，去除了有效抗菌基团后的四环素，即化学改性的四环素仍能抑制胶原酶活性。